甲型血友病（血友病A）需定期补充的凝血因子是
A. 人凝血因子Ⅱ
B. 人凝血因子Ⅸ
C. 人凝血因子Ⅹ
D. 人凝血因子Ⅶ
E. 人凝血因子Ⅷ

正确答案：E。人凝血因子Ⅷ

解析：本题考查凝血因子的应用。甲型血友病（血友病A）需定期补充的凝血因子是人凝血因子Ⅷ（E对）。